伤寒
A. 玫瑰疹
B. 斑丘疹
C. 脓疱疹
D. 荨麻疹
E. 单纯疱疹

正确答案：A。玫瑰疹